茜草不具有的功效是
A. 止血
B. 凉血
C. 通经
D. 通乳
E. 祛瘀

正确答案：D。通乳

解析：本题考查的是止血药茜草的功效。茜草不具有的功效是通乳（D错，为本题正确答案）。茜草：【功效】凉血（B对），祛瘀（E对），止血（A对），通经（C对）。通乳为蒲公英的功效。蒲公英：【功效】清热解毒，消痈散结，利湿通淋。